常规血液透析的禁忌证是
A. 肺部感染
B. 新发脑出血
C. 急性左心衰竭
D. 糖尿病
E. 高血压

正确答案：B。新发脑出血

解析：血液透析可应用于急性肾损伤、慢性肾衰竭，急性左心衰（C错），严重水、电解质、酸碱平衡紊乱。血液透析时需要抗凝治疗，故新发脑出血（B错）病人禁忌使用。